形成3'，5'环化鸟苷酸时需要
A. ATP
B. CTP
C. GTP
D. UTP
E. TTP

正确答案：C。GTP